氰化物中毒时可选用
A. 阿托品
B. 亚甲蓝（美蓝）
C. 硫代硫酸钠
D. 亚硝酸钠
E. 谷胱甘肽

正确答案：B、C、D。亚甲蓝（美蓝）；硫代硫酸钠；亚硝酸钠

解析：本题考查氰化物中毒解救。氰化物中毒时可选用亚甲蓝（美蓝）（B对）、硫代硫酸钠（次亚硫酸钠）（C对）及亚硝酸钠（D对）。亚甲蓝（美蓝）用于氰化物中毒，小剂量可治疗高铁血红蛋白血症（亚硝酸盐中毒等）。硫代硫酸钠（次亚硫酸钠）主要用于氰化物中毒，也用于砷、汞、铅中毒等。亚硝酸钠治疗氰化物中毒。阿托品（A错）可用于有机磷中毒。谷胱甘肽（E错）用于丙烯腈、氟化物、一氧化碳、重金属等中毒。